士的宁又称
A. 莨菪碱
B. 番木鳖碱
C. 延胡索乙素
D. 山莨菪碱
E. 雷公藤甲素

正确答案：B。番木鳖碱

解析：本题考查的是士的宁的别称。士的宁又称番木鳖碱（B对）。番木鳖碱又称士的宁，是马钱子的主要生物碱。马钱子成熟种子中生物碱含量为1.5%～5%，主要生物碱是士的宁（又称番木鳖碱）、马钱子碱及其氮氧化物，还含少量的10余种其他吲哚类生物碱，其中以士的宁含量居首，占总碱量的35%～50%，其次是马钱子碱，占总碱量的30%～40%。《中国药典》以士的宁和马钱子碱为指标成分进行含量测定，要求士的宁的含量应为1.20%～2.20%，马钱子碱的含量不得少于0.80%。莨菪碱（A错）又称阿托品，与山莨菪碱（D错）是洋金花的主要生物碱之一。洋金花主要化学成分为莨菪烷类生物碱，由莨菪醇类和芳香族有机酸结合生成的一元酯类化合物。主要有莨菪碱（阿托品）、山莨菪碱、东莨菪碱、樟柳碱和N-去甲莨菪碱。《中国药典》以东莨菪碱为指标成分进行含量测定，要求东莨菪碱不得少于0.15%。延胡索乙素（C错）又称dl-四氢巴马汀，为延胡索的主要化学成分。延胡索含有多种苄基异喹啉类生物碱，包括延胡索甲素、延胡索乙素和去氢延胡索甲素等，这些生物碱的类型为原小檗碱型、原托品碱型、阿朴菲型等六种异喹啉型生物碱，其中多数属原小檗碱型。《中国药典》以延胡索乙素为指标成分进行含量测定，要求含量不得少于0.050%。雷公藤甲素（E错）为雷公藤的主要化学成分。雷公藤主要生物碱及其化学结构：雷公藤中主要化学成分为雷公藤甲素、雷公藤乙素和雷公藤红素等。其中，雷公藤甲素为二萜类化合物，不是生物碱。